髋肌前群有
A. 梨状肌
B. 臀小肌
C. 髂腰肌
D. 闭孔内肌
E. 股方肌

正确答案：C。髂腰肌

解析：髂腰肌（C对）属于髋肌前群。梨状肌（A错）、臀小肌（B错）、闭孔内肌（D错）、股方肌（E错）属于髋肌后群。